骨结核病变炎症波及周围组织时，淋巴结可彼此粘连成团，或与皮肤粘连。皮肤表面无红、热及明显压痛，扪之有波动，称为
A. 疖
B. 痈
C. 脓肿
D. 丹毒
E. 冷脓肿

正确答案：E。冷脓肿

解析：骨结核病变继续发展，淋巴结中心因有干酪样坏死，组织溶解变软，逐渐液化破溃。炎症波及周围组织时，淋巴结可彼此粘连成团，或与皮肤粘连。皮肤表面无红、热及明显压痛，扪之有波动感。此种液化现象称为冷脓肿。掌握“面部疖痈”知识点。